对腰椎结核诊断有意义的是
A. 直腿抬高试验
B. 拾物试验
C. Mills征
D. Hoffmann征
E. 抽屉试验

正确答案：B。拾物试验

解析：腰椎结核时，体征检查中拾物试验为阳性，变现为病人从地上拾物时，不能弯腰，需挺腰屈膝屈髋下蹲才能取物。直腿抬高试验（P733）（A错）主要用于腰椎间盘突出时的体征检查。Mills征（P719）（C错）主要用于肱骨外上裸炎时的体征检查。Hoffmann征（P727）（D错）主要用于脊髓型颈椎病时的体征检查。抽屉试验（P667）（E错）主要用于交叉韧带损伤时的体征检查。